影响因素作用的因素包括药物因素和机体因素，在机体因素中，有生理因素、精神因素、疾病因素、遗传因素、时辰因素等，直接或间接影响药物疗效和不良反应。肾功能不全患者使用阿米卡星须减量慎用，这种影响药物作用的因素属于
A. 药物因素
B. 精神因素
C. 疾病因素
D. 遗传因素
E. 时辰因素

正确答案：C。疾病因素

解析：本题考查影响药物的作用因素。肾功能不全患者使用阿米卡星须减量慎用，这种影响药物作用的因素属于疾病因素（C对）。肾功能不全者可使阿米卡星等主要经肾排泄的药物排出减慢，t1/2延长，易引起蓄积中毒等。